能益肾强腰的药是
A. 党参
B. 人参
C. 西洋参
D. 太子参
E. 刺五加

正确答案：E。刺五加

解析：本题考查的是刺五加的功效。能益肾强腰的药是刺五加（E对）。刺五加：【功效】补气健脾，益肾强腰，养心安神，活血通络。党参（A错）：【功效】补中益气，生津养血。人参（B错）：【功效】大补元气，补脾益肺，生津止渴，安神益智。西洋参（C错）：【功效】补气养阴，清热生津。太子参（D错）：【功效】补气生津。